化脓性细菌侵入血流后，在其中大量繁殖，并通过血流扩散到机体其他组织或器官，产生新的化脓性病灶，称为
A. 菌血症
B. 毒血症
C. 败血症
D. 脓毒血症
E. 内毒素血症

正确答案：D。脓毒血症

解析：脓毒症指细菌感染机体后，证实循环血液中存在致病菌（血液培养细菌阳性）或细菌毒素，或存在高度可疑的感染灶；并已引起全身炎症反应综合征（SIRS）。掌握“宿主的抗菌免疫及感染的发生发展”知识点。